呕吐粪样内容物，腹部高度膨胀的原因是
A. 麻痹性肠梗阻
B. 低位肠梗阻
C. 痉挛性肠梗阻
D. 绞窄性肠梗阻
E. 高位肠梗阻

正确答案：B。低位肠梗阻

解析：低位肠梗阻（B对）因梗阻位置较低，呕吐发生较晚，梗阻位置以上的肠管较多，因此扩张的范围较广，可出现显著的腹胀，腹部高度膨胀，且其肠内容物经发酵呈粪样，因此呕吐物后期为粪样内容物。高位肠梗阻（E错）较显著的特点是呕吐发生较早、较频繁，呕吐物常为胃及十二指肠内容物，且腹胀不明显。痉挛性肠梗阻（C错）相对比较少见，可发生于急性肠炎、慢性铅中毒或肠功能紊乱的病人。麻痹性肠梗阻（A错）腹胀较显著，因为其肠壁肌呈瘫痪状态因此无收缩即无阵发性腹痛，只有持续性胀痛或不适，肠鸣音可减弱或消失，其呕吐常为溢出性。绞窄性肠梗阻（D错）为伴有相应肠段血运障碍的肠梗阻，其特点常为持续性的剧烈腹痛，可有腹膜刺激征阳性及粘液脓血便，若呕吐物呈棕褐色或血性，应考虑肠管血运障碍。